使瞳孔转向外方的是
A. 上直肌
B. 下直肌
C. 上斜肌
D. 下斜肌
E. 外直肌

正确答案：E。外直肌

解析：外直肌（E对）使瞳孔转向外方；上直肌（A错）使瞳孔转向上内方；下直肌（B错）使瞳孔转向下内方；上斜肌（C错）使瞳孔转向下外方；下斜肌（D错）使瞳孔转向上外方。